意识障碍伴瞳孔散大可见于
A. 海洛因中毒
B. 巴比妥类中毒
C. 有机磷中毒
D. 酒精中毒
E. 吗啡中毒

正确答案：D。酒精中毒

解析：意识障碍是指人对周围环境及自身状态的识别和觉察能力出现障碍。意识障碍伴瞳孔散大可见于酒精中毒（D对）。海洛因中毒（A错）、巴比妥类中毒（B错）、有机磷中毒（C错）、吗啡中毒（E错）均表现为意识障碍伴瞳孔缩小。